风油精适用于
A. 四肢麻木
B. 关节痛
C. 皮肤瘙痒
D. 轻度水、火烫伤
E. 伤风感冒引起的头痛

正确答案：E。伤风感冒引起的头痛